齿状线
A. 肛柱下端与肛瓣边缘的环形线
B. 肛柱上端的环形线
C. 又称为肛直肠线
D. 临床上称为痔环
E. 是肛门内、外括约肌的分界线

正确答案：A。肛柱下端与肛瓣边缘的环形线

解析：齿状线为连接各肛柱下端与肛瓣边缘的环形线(A对)，肛柱上端的环形线为肛直肠线(B错)，齿状线又称为肛皮线(C错)，肛梳在临床上称痔环(D错)，白线为肛门内外括约肌的分界线(E错)。